女性，16岁。低热咳嗽1个月，查体：消瘦，右颈部可触及数个绿豆大小淋巴结，稍硬、活动、无压痛，右肺呼吸音稍减弱，胸片见右上钙化灶，右肺门淋巴结肿大，诊断首先考虑的是
A. 原发型肺结核
B. 浸润型肺结核
C. 血行播散型肺结核
D. 结核性渗出性胸膜炎
E. 慢性纤维空洞型肺结核

正确答案：A。原发型肺结核

解析：患者为青少年女性，消瘦，有低热、咳嗽，可触及肿大淋巴结，胸片可见原发钙化灶，肺门淋巴结肿大（为原发型肺结核的典型胸片改变），根据其临床表现和辅助检查，考虑诊断为原发型肺结核（A对）。浸润型肺结核（B错）（P68）胸片表现为小片状或斑点状阴影，可融合形成空洞，好发于上叶尖后段和下叶背段。血行播散型肺结核（C错）（P67）多起病急，持续高热，中毒症状重，胸片可发现大小、密度、分布三均匀的粟粒状结节影。炎症累及胸膜时即结核性渗出性胸膜炎（D错）（P118）可有胸膜性胸痛，出现胸腔积液等。慢性纤维空洞型肺结核（E错）（P68）的特点是病程长，反复进展恶化，肺组织破坏严重，肺功能严重受损，胸片示病灶呈纤维厚壁空洞、肺门抬高和肺纹理呈垂柳样。